可用于预防风湿热复发的药物是
A. 庆大霉素
B. 呋喃妥因
C. 苄星青霉素
D. 甲硝唑
E. 左氧氟沙星

正确答案：C。苄星青霉素

解析：本题考查苄星青霉素。可用于预防风湿热复发的药物是苄星青霉素（C对）。庆大霉素（A错）用于敏感菌引起的痢疾、肠炎等肠道感染性疾病，也可用于腹部术前清洁肠腔。呋喃妥因（B错）用于对其敏感的大肠埃希菌、肠球菌属、葡萄球菌属以及克雷伯菌属、肠杆菌属等细菌所致的急性单纯性下尿路感染，也可用于尿路感染的预防。甲硝唑（D错）用于治疗肠道和肠外阿米巴病。左氧氟沙星（E错）适用于敏感革兰氏阴性菌和革兰氏阳性细菌引起的感染和淋球菌、沙眼衣原体所致的尿道炎、宫颈炎等。